要从混合的T、B细胞中分离T细胞，最佳的方法是
A. 流式细胞技术
B. 放射免疫分析法
C. ELISA
D. 双向琼脂扩散试验
E. 免疫电泳

正确答案：A。流式细胞技术

解析：放射免疫分析法（B错）、ELISA（C错）、双向琼脂扩散试验（D错）、免疫电泳（E错）都是检测抗原或抗体的体外实验，不能用来分离细胞。流式细胞术（A对）是一种集光学、流体力学、电力学和计算机技术于一体，可对细胞进行多参数定量测定和综合分析的方法，可用来分离各种细胞。